某男，32岁。因痰气阻肺导致咳嗽痰多、胸闷气急。治当化痰止咳、宽中下气，宜选用的成药是
A. 橘贝半夏颗粒
B. 人参保肺丸
C. 七味都气丸
D. 二陈丸
E. 橘红丸

正确答案：A。橘贝半夏颗粒

解析：本题考查的是橘贝半夏颗粒的功能。治当化痰止咳、宽中下气，宜选用的成药是橘贝半夏颗粒（A对）。橘贝半夏颗粒【功能】化痰止咳，宽中下气。人参保肺丸（B错）【功能】益气补肺，止嗽定喘。七味都气丸（C错）【功能】补肾纳气，涩精止遗。二陈丸（D错）【功能】燥湿化痰，理气和胃。橘红丸（E错）【功能】清肺，化痰，止咳。